含有骈合双环结构的ACE抑制剂是
A. 赖诺普利
B. 福辛普利
C. 马来酸依那普利
D. 卡托普利
E. 雷米普利

正确答案：E。雷米普利

解析：本题考查雷米普利的化学结构。雷米普利（E对）为ACE抑制剂，结构中含有两个骈合的5元环。